为前体药物，但不含酸性结构的药物是
A. 丙磺舒
B. 美洛昔康
C. 萘美丁酮
D. 酮洛芬
E. 芬布芬

正确答案：E。芬布芬